传染病的主要发病危险因素是
A. 生物性致病因素
B. 物理因素
C. 两者均有
D. 两者均无

正确答案：A。生物性致病因素

解析：本题考查传染病的发病危险因素。传染病是由病原体引起的，能在人与人、动物与动物以及人与动物之间相互传播的疾病。病原体是指能够引起宿主致病的各类生物，包括病毒、细菌、立克次体、支原体、衣原体、螺旋体、真菌以及朊病毒等各种微生物以及寄生虫等。可知传染病的主要发病危险因素是生物性致病因素（A对BCD错）。